每次开处方，每张处方所包含的药品种类上限为
A. 5种
B. 3种
C. 6种
D. 4种
E. 7种

正确答案：A。5种

解析：根据2007年卫生部《处方管理办法》规定，每次开处方，每张西药，中成药处方所包含的药品种类上限为5种（A对）。